男，38岁，发热2周，胸闷5天。无咳嗽、咳痰和咯血，曾使用“三代头孢菌素”抗感染治疗无效。查体：T37.8℃，BP140/90mmHg。右下肺呼吸音消失，语音共振减弱。胸部X线片示右下肺大片状密度增高影，上缘呈外高内低弧形。为明确诊断应首选的检查是
A. 超声心动图
B. 支气管镜
C. 胸部CT
D. 胸腔穿刺抽液
E. 血肿瘤标志物

正确答案：D。胸腔穿刺抽液

解析：患者发热、胸闷，无咳嗽、咳痰和咯血，曾使用“三代头孢菌素”抗感染治疗无效，右下肺呼吸音消失，语音共振减弱，胸部X线显示右下肺大片状高密度影，上缘呈外高内低弧形，根据其临床表现和辅助检查，考虑诊断为结核性胸腔积液。结核性胸腔积液为渗出液，为明确诊断，首选胸腔穿刺抽液（D对）。超声心动图（A错）主要用于心包积液、心肌病、心脏瓣膜病的辅助诊断。支气管镜（B错）主要用于中央型肺癌的诊断，对确定病变范围、明确手术指征与方式有帮助。胸部CT（C错）为影像学检查，可有助于病因的诊断，但不能明确诊断。血肿瘤标志物（E错）检查主要用于恶性肿瘤的辅助诊断。